牙体缺损修复时，牙体预备应达到的要求哪项是错误的
A. 去除病变组织
B. 防止损伤邻牙
C. 保护软组织
D. 尽量多次预备完成
E. 保护牙髓

正确答案：D。尽量多次预备完成

解析：牙体预备的要求包括以下方面：①去除病变组织。②防止损伤邻牙。③保护软组织。④保护牙髓。⑤适当磨除牙体组织。⑥预防和减少继发龋。⑦牙体预备尽量一次完成。⑧暂时冠保护。掌握“牙体缺损修复治疗原则”知识点。